患者，女，35岁，复杂部分发作性癫痫病史12年，最初使用苯妥英钠单药治疗，6个月前因癫痫控制不佳提高苯妥英钠剂量，因不能耐受不良反应换用卡马西平联合丙戊酸钠治疗，癫痫得到控制。患者近期出现体重增加及严重脱发，到神经内科复诊。患者同时患有2型糖尿病，长期口服二甲双胍、阿卡波糖治疗。此外患者长期服用复合维生素B。患者计划口服避孕药避孕，可能增加避孕失败风险的药物是
A. 卡马西平
B. 二甲双胍
C. 丙戊酸钠
D. 阿卡波糖
E. 复合维生素B

正确答案：A。卡马西平

解析：本题考查卡马西平。可能增加避孕失败风险的药物是卡马西平（A对）。卡马西平为肝药酶诱导剂，可以增强肝药酶活性的药物，使药物失效加快。二甲双胍（B错）用于单纯饮食控制不满意的Ⅱ型糖尿病病人，尤其是肥胖和伴高胰岛素血症者。丙戊酸钠（C错）是肝药酶抑制剂，不是肝药酶诱导剂。阿卡波糖（D错）用于治疗糖尿病，或降低糖耐量低减者的餐后血糖。复合维生素B（E错）用于预防和治疗B族维生素缺乏所致的营养不良、厌食、脚气病、糙皮病等。